眼后房是指
A. 角膜与晶状体之间腔隙
B. 角膜与虹膜之间腔隙
C. 虹膜与晶状体之间腔隙
D. 虹膜与玻璃体之间腔隙

正确答案：C。虹膜与晶状体之间腔隙

解析：眼房是角膜与晶状体之间的间隙，中间被虹膜分隔。眼前房是指角膜与虹膜之间腔隙（B错），眼后房虹膜与晶状体之间腔隙（C对）。